下列各项，除哪项外，均是消渴发病的主要病机
A. 燥热
B. 气虚
C. 阴虚
D. 血瘀
E. 水停

正确答案：E。水停

解析：阴虚为本（C对），燥热为标（A对）是消渴基本病机特点，由于阴阳互根，若病程日久，阴损及阳，可致阴阳俱虚和气虚（B对）。消渴病是一种病及多个脏腑的疾病，气血运行失常，阴虚内热，耗伤津液，又可导致血行不畅、血脉瘀滞（D对）（E错，为本题正确答案）。